汞毒作用的基础是
A. 与红细胞结合
B. 与血红蛋白结合
C. 与蛋白质的巯基结合
D. 与金属硫蛋白结合
E. 与核酸结合

正确答案：C。与蛋白质的巯基结合